慢性牙周炎与慢性龈炎的不同点为
A. 牙菌斑是致病因素
B. 有牙龈炎症
C. 龈沟深度加深
D. 有牙槽骨吸收
E. 需洁治治疗

正确答案：D。有牙槽骨吸收

解析：牙周炎与牙龈炎最根本的区别在于牙周炎有牙菌斑生物膜引起牙周支持组织的破坏，牙周袋形成和炎症、附着丧失和牙槽骨吸收，最后可导致牙齿的丧失。附着水平是反映牙周组织破坏程度的重要指标之一，有无附着丧失是区分牙周炎与牙龈炎的重要指标。掌握“慢性牙周炎的病因，表现诊断及预后”知识点。